60岁男性，活动中突感眩晕，枕部疼痛、呕吐、步行不稳，20分钟后昏迷，呼吸节律不整，诊断脑出血，其部位是
A. 脑颞叶
B. 基底节
C. 脑室
D. 脑桥
E. 小脑

正确答案：E。小脑